改进寇氏法要求
A. 设5～7个剂量组
B. 每个剂量组小鼠不可少于10只
C. 组距为几何级数
D. 死亡率呈常态分布
E. 以上都是

正确答案：E。以上都是